出现胆红素尿的疾病是
A. 溶血性黄疸
B. 肝细胞性黄疸
C. 急性肾小球肾炎
D. 泌尿系结石
E. 膀胱炎

正确答案：B。肝细胞性黄疸

解析：肝细胞损伤时其对胆红素的摄取、结合、排除功能均可能受损。由于肝细胞摄取血浆中未结合胆红素能力下降使其在血中的浓度升高，所产生的结合胆红素又可能由于肝细胞肿胀、毛细胆管受压，而在肿胀与坏死的肝细胞间弥散经血窦进入血循环，导致血中结合胆红素亦升高，因其可溶于水并经肾排出，使尿胆红素试验呈阳性（B对）。溶血性黄疸中血清总胆红素增加，以非结合胆红素为主，结合胆红素基本正常。由于血中非结合胆红素增加，结合胆红素形成也代偿性增加，从胆道排至肠道也增加，致尿胆原增加，粪胆素随之增加，粪色加深。肠内的尿胆原增加，重吸收至肝内者也增加，由于缺氧及毒素作用，肝处理较正常增多的尿胆原的能力降低，致血中尿胆原增加，并从肾脏排出，故尿中尿胆原增加，但无胆红素（A错）。急性肾小球肾炎主要表现为血尿、蛋白尿水肿和高血压，可伴一过性氮质血症，具有自愈倾向（C错）。尿路结石主要症状是疼痛及血尿。通常患者都会出现肉眼或镜下血尿，后者更为常见（D错）。排尿时尿道有烧灼痛，尿频，往往伴尿急，严重时类似尿失禁，尿频尿急常特别明显，每小时可达5～6次以上，每次尿量不多，甚至只有几滴，排尿终末可有下腹部疼痛。尿液混浊，有时出现血尿，常在终末期明显（E错）。